以下药物的鉴别反应是：盐酸氯丙嗪
A. 取供试品0.1g，加水与0.4%氢氧化钠溶液各3ml，加硫酸铜试液1滴，生成草绿色沉淀
B. 取供试品适量，加水溶解后，加溴化氰试液和苯胺溶液渐显黄色
C. 取供试品10mg，加水1ml溶解后，加硝酸5滴，即显红色；渐变淡黄色
D. 取供试品适量，加硫酸溶解后，在365nm的紫外光下显黄绿色荧光
E. 取供试品，加香草醛试液，生成黄色结晶，结晶的熔点为228～231℃

正确答案：C。取供试品10mg，加水1ml溶解后，加硝酸5滴，即显红色；渐变淡黄色